Hill准则中，与Mill法则中的共变法最接近的是
A. 剂量-反应关系
B. 生物学合理性
C. 实验证据
D. 结果的一致性
E. 特异性

正确答案：A。剂量-反应关系

解析：本题考查Hill准则和Mill法则。共变法认为当某一现象存在一种变异或发生一种变化时，另一现象相应存在变异或随之发生变化，且不论后者的变异和变化是什么，那么二者间可能存在因果关系。剂量-反应关系指疾病的发生率随可疑病因的强度或数量的变化而变化的现象。剂量-反应关系的存在进一步支持因果关系的存在。因此，Hill准则中的剂量-反应关系（A对BCDE错）与Mill法则中的共变法最接近，两者都验证了因果关系的进一步存在。